女性，49岁。近半年数次发作性右上腹疼痛，恶心呕吐，多为夜间睡眠后发作，并向右肩部放射。检查：肥胖体质，BP110/90mmHg，P90次/分，右上腹轻度压痛，无腹肌紧张。此病人最可能的诊断是
A. 高位急性阑尾炎
B. 胆囊腺瘤性息肉
C. 十二指肠溃疡穿孔
D. 急性胰腺炎
E. 胆囊结石

正确答案：E。胆囊结石

解析：患者中年女性，近半年来夜间睡眠后数次发作右上腹痛、向右肩部放射、右上腹轻度压痛（胆囊结石典型症状），根据病史及检查，最可能的诊断是胆囊结石（E对）。高位急性阑尾炎（A错）多表现为转移性腹痛，有麦氏点压痛，且疼痛为持续性，阑尾化脓、坏疽、穿孔时可有腹肌紧张。胆囊腺瘤性息肉（B错）一般症状轻微，甚至无症状，多在B超检查胆囊时发现。十二指肠溃疡穿孔（C错）上腹部刀割样剧痛，且有腹肌紧张。急性胰腺炎（D错）腹痛多为持续进行性加重，位于左上腹。